肺胀晚期，病变为主的脏是
A. 肺、脾、肾
B. 肺、脾、心
C. 肺、肾、心
D. 脾、肾、心
E. 肺、肝、肾

正确答案：C。肺、肾、心

解析：肺胀的病变早期在肺，若肺病及脾，子耗母气，脾失健运致肺脾两虚。肺为气之主，肾为气之根，久病肺病及肾，致肾气衰惫，肺不主气，肾不纳气，致肺肾气虚。心脉上通于肺，肺气辅佐心脏运行血脉，肺失治节，病久肺病及心，致心阳损伤。心阳根于命门真火，肺肾虚弱，可进一步导致心的阳气虚衰。故肺胀早期以肺脾、肺肾的气虚或气阴两虚为主，病变以肺、脾、肾为主，后期气虚及阳甚至阴阳两虚，病变以肺、肾、心为主，肝脏不是肺胀的病变脏腑（C对ABCE错）。